黏液表皮样癌多好发于
A. 腮腺
B. 唇腺
C. 腭腺
D. 小唾液腺
E. 下颌下腺

正确答案：A。腮腺

解析：本题考查黏液表皮样癌。黏液表皮样癌患者女性多于男性，发生于腮腺者（A对）居多，其次是腭部和下颌下腺，也可发生于其他小唾液腺，特别是磨牙后腺。